高血压合并窦性心动过速的患者首选的降压药物为
A. 依那普利
B. 美托洛尔
C. 氢氯噻嗪
D. 特拉唑嗪
E. 氨氯地平

正确答案：B。美托洛尔

解析：美托洛尔（B对）是选择性β₁受体阻滞剂，对心脏有全面抑制作用，主要表现为心率减慢、心肌收缩力减弱，可用于治疗高血压合并窦性心动过速，是高血压合并窦性心动过速的患者首选的降压药物。依那普利（A错）是是血管紧张素转化酶抑制剂，阻止AngⅡ的生成，取消AngⅡ收缩血管、增加血容量、升高血压等作用，可治疗高血压、充血性心力衰竭与心肌梗死、糖尿病肾病和其他肾病等，对心率的影响较小。氢氯噻嗪（C错）是噻嗪类利尿剂，主要用于各种原因引起的水肿、高血压病，对心率影响较小。特拉唑嗪（D错）是α受体阻滞剂，主要用于治疗前列腺炎的治疗。氨氯地平（E对）是钙通道阻滞剂，主要用于高血压、心绞痛的治疗，但其可反射性引起心率加快，故不用于心率快的高血压患者。